中药中对多糖溶解度最大的溶剂是
A. 水
B. 甲醇
C. 乙醇
D. 乙酸乙酯
E. 甲醚

正确答案：A。水

解析：本题考查的是多糖的溶解性。中药中对多糖溶解度最大的溶剂是水（A对）。多聚糖一般难溶于冷水，或溶于热水形成胶体溶液，但随着醇的浓度增加溶解度降低。不溶于有机溶剂。甲醇（B错）、乙醇（C错）、乙酸乙酯（D错）、甲醚（E错）为有机溶剂。